牙周附着水平是指
A. 龈缘到袋底的距离
B. 釉牙骨质界到袋底的距离
C. 龈缘到釉牙骨质界的距离
D. 釉牙骨质界到根分歧的距离
E. 结合上皮到牙槽嵴顶的距离

正确答案：B。釉牙骨质界到袋底的距离

解析：本题考查牙周疾病促进因素。牙周附着水平是指：釉牙骨质界到袋底的距离（B对），龈沟底与牙槽嵴顶之间的恒定距离称为生物学宽度。